就服务范围而言，社区卫生服务的综合性特点包括
A. 个人、家庭和社区
B. 家庭和社区
C. 医院内和医院外
D. 病人和非病人
E. 持续性和非持续性

正确答案：A。个人、家庭和社区

解析：本题考查社区卫生服务的综合性特点。社区卫生服务的综合性服务，就服务范围而言，覆盖个人、家庭与社区（A对BCDE错），即照顾社区中所有单位、家庭与个人。